根据《药品说明书和标签管理规定》药品商品名单字面积不得大于通用名的
A. 1∕5
B. 1∕4
C. 1∕3
D. 1∕2
E. 2∕4

正确答案：D。1∕2

解析：本题考查商品名称。根据《药品说明书和标签管理规定》药品商品名单字面积不得大于通用名的1/2（D对）。药品商品名称不得与通用名称同行书写，其字体和颜色不得比通用名称更突出和显著，其字体以单字面积计不得大于通用名称所用字体的二分之一。